髓室增龄变化的继发性牙本质沉积方式因牙位而不同，磨牙继发性牙本质主要沉积
A. 髓室舌侧壁
B. 髓室唇侧壁
C. 髓室顶和侧壁
D. 髓室底
E. 髓室顶

正确答案：D。髓室底

解析：磨牙主要沉积在髓室底，其次为髓室顶和侧壁。掌握“髓腔各部分名称、增龄性变化及临床意义”知识点。